心脏手术常用的抗凝药是
A. 肝素
B. 华法林
C. 尿激酶
D. 阿司匹林
E. 枸橼酸钠

正确答案：B。华法林

解析：华法林（B对）属于香豆素类抗凝药，能抑制肝脏的维生素K环氧还原酶，阻止维生素K的环氧型向氢醌型的转变，从而阻止维生素K的再利用，影响凝血因子Ⅱ、Ⅶ、Ⅸ、Ⅹ的γ羧化，阻止其活化，产生抗凝作用，临床可用于心脏外科手术和冠状动脉闭塞，还可作为心梗辅助药物。肝素（A错）在体内外均有强大的抗凝作用，静脉注射后，抗凝作用立即发生，可使多种凝血因子灭活，临床主要用于血栓栓塞性疾病、弥散性血管内凝血、防治心肌梗死、脑梗死、心血管手术及外周静脉术后血栓形成、体外抗凝等。尿激酶（C错）可直接激活纤维蛋白溶酶原转变为纤溶酶，发挥溶血栓作用，主要用于血栓栓塞性疾病如肺栓塞和深部静脉血栓。阿司匹林（D错）属于抗血小板药，可不可逆抑制COX-1活性，从而抑制血小板的合成和血管内膜TXA2的合成，小剂量主要用于防止冠状动脉性疾病、心肌梗死、脑梗死等。枸橼酸钠（E错）与血液或血浆中的Ca²⁺结合成难以解离的可溶性枸橼酸钙，使血液中钙离子减少，产生抗凝作用，临床主要用于体外抗凝。